下列有关影响牙周病流行的因素的叙述中，错误的是
A. 口腔卫生好，龈炎发病率低，牙周状况就好
B. 吸烟者牙周病患病危险高于不吸烟者
C. 营养状况对牙周组织功能无影响
D. 糖尿病对牙周组织的疾病有一定的影响
E. 蛋白质缺乏可使牙周结缔组织变性，牙槽骨疏松

正确答案：C。营养状况对牙周组织功能无影响

解析：营养：营养状况是影响牙周组织对致病因素抵抗力的重要条件之一。人体需要的营养包括碳水合物、脂肪、蛋白质、纤维、矿物质，这些营养成分为牙周组织的代谢、修复和维持正常功能所必需。营养缺乏将造成牙周组织功能降低。蛋白质缺乏可使牙周结缔组织变性，牙槽骨疏松；还可影响抗体蛋白合成，免疫能力下降；维生素与牙周组织胶原合成有关，它们的缺乏造成牙周组织创伤愈合困难。掌握“牙周病流行病学及分级预防”知识点。